口腔癌的警告标志不包括
A. 2周以上未愈合的口腔溃疡
B. 自发性牙痛
C. 口腔黏膜白斑
D. 口腔黏膜红斑
E. 口腔和颈部不正常的淋巴结肿大

正确答案：B。自发性牙痛

解析：口腔癌的警告标志如下：①腔内的溃疡，2周以上尚未愈合；②口腔黏膜有白色、红色和发暗的斑；③口腔与颈部有不正常的肿胀和淋巴结肿大；④口腔反复出血，出血原因不明；⑤面部、口腔、咽部和颈部有不明原因的麻木与疼痛。掌握“口腔癌的预防”知识点。